痛风症是因为血中某种物质在关节、软组织处沉积，其成分为
A. 尿酸
B. 尿素
C. 胆固醇
D. 黄嘌呤
E. 次黄嘌呤

正确答案：A。尿酸